下列关于药物代谢说法错误的是
A. 舍曲林为含有两个手性中心，目前使用的是S，S-（+）构型异构体
B. 氟西汀在体内代谢生成去甲氟西汀，去甲氟西汀的t1/2为330小时
C. 文拉法辛代谢为去甲基文拉法辛，代谢产物没有活性
D. 艾司西酞普兰的抗抑郁活性为西酞普兰的2倍，是R对映体活性的至少27倍
E. 帕罗西汀包含两个手性中心，目前使用的是（3S，4R）-（-）-异构体

正确答案：C。文拉法辛代谢为去甲基文拉法辛，代谢产物没有活性

解析：本题考查抗抑郁药的结构特点。文拉法辛和它的活性代谢物O-去甲文拉法辛，都有双重的作用机制（C错，为本题正确答案）。舍曲林含两个手性中心的选择性5-羟色胺再摄取抑制药；目前使用的是S，S-（+）-异构体（A对）。氟西汀的主要的代谢产物均为N-去甲氟西汀，其半衰期为330小时，去甲氟西（B对）汀半衰期很长，会产生积蓄及排泄缓慢的现象。艾司西酞普兰的抗抑郁活性为西酞普兰的2倍，是R对映体活性的至少27倍（D对）。帕罗西汀含两个手性中心，市售帕罗西汀的构型是（3S，4R）-（-）-异构体（E对）。